患者，女，35岁。黄疸贫血伴关节酸痛3个月，体检检查巩膜黄染，脾肋下2cm，血红蛋白58g/L，白细胞5×10⁹/L，网织红细胞计数25%，外周血涂片成熟红细胞形态正常，尿隐血试验阴性。经治疗缓解后，又出现上述症状，同时采取哪种措施
A. 大剂量丙种球蛋白
B. 脾切除
C. α-干扰素
D. 6-TG
E. ATG

正确答案：B。脾切除

解析：患者考虑为温抗体型自身免疫性溶血性贫血，治疗首选糖皮质激素，经糖皮质激素治疗缓解后，又出现上述症状，提示糖皮质激素疗效不佳，应同时采用脾切除治疗（B对）。大剂量丙种球蛋白（A错）有一定疗效，但作用不持久。温抗体型AIHA治疗一般不选用α-干扰素（C错）、6-TG（D错）、ATG（E错）。